根据《药品召回管理办法》规定，药品监督管理部门认为药品生产企业召回不彻底或者需要采取更为有效的措施的
A. 可以要求药品生产企业停产、停业整顿
B. 可以要求药品生产企业重新召回
C. 可以要求药品生产企业扩大召回范围
D. 可以吊销药品生产企业的《药品生产许可证》
E. 可以吊销药品批准证明文件

正确答案：B、C。可以要求药品生产企业重新召回；可以要求药品生产企业扩大召回范围

解析：本题考查药品的召回。根据《药品召回管理办法》规定，药品监督管理部门认为药品生产企业召回不彻底或者需要采取更为有效的措施的，可以要求药品生产企业重新召回（B对）、可以要求药品生产企业扩大召回范围（C对）。《药品召回管理办法》第二十四条规定，经过审查和评价，认为召回不彻底或者需要采取更为有效的措施的，药品监督管理部门应当要求药品生产企业重新召回或者扩大召回范围。